异烟肼+盐酸吡多辛（VB₆）治疗结核属于
A. 提高药物疗效
B. 减少不良反应
C. 治疗多种疾病
D. 延缓细菌耐药性的产生
E. 加速细菌胞壁破裂

正确答案：B。减少不良反应